大孔吸附树脂吸附的化合物用水充分洗脱后，再用丙酮洗下的通常是
A. 单糖
B. 鞣质
C. 低聚糖
D. 中性亲脂性成分
E. 氨基酸

正确答案：D。中性亲脂性成分